下列哪项不是胎盘剥离征象
A. 宫底升高且软
B. 子宫底升高且硬
C. 阴道少量出血
D. 外露脐带延长
E. 压耻骨联合上方，脐带不回缩

正确答案：A。宫底升高且软